主成分为含水硫酸钠（Na₂SO₄·10H₂O）的药材是
A. 石膏
B. 磁石
C. 芒硝
D. 滑石
E. 信石

正确答案：C。芒硝

解析：本题考查的是芒硝的来源。主成分为含水硫酸钠（Na₂SO₄·10H₂O）的药材是芒硝（C对）。芒硝：【来源】为硫酸盐类矿物芒硝族芒硝，经加工精制而成的结晶体。主含含水硫酸钠（Na₂SO₄·10H₂O）。石膏（A错）：【来源】为硫酸盐类矿物硬石膏族石膏。主含含水硫酸钙（CaSO₄·2H₂O）。磁石（B错）为含铁氧化物。滑石（D错）：【来源】为硅酸盐类矿物滑石族滑石。主要含含水硅酸镁[Mg₃（Si₄O₁₀）（OH）₂]。信石（E错）为含砷氧化物。